按十二经脉分布规律，太阳经行于
A. 面额
B. 头后
C. 头侧
D. 前额
E. 面部

正确答案：B。头后

解析：阳经在头面部的分布特点是：阳明经主要行于面部（E错），其中足阳明经行于额部（AD错）；少阳经主要行于侧头部（C错）；手太阳经主要行于面颊部，足太阳经行于头顶和头后部（B对）。